双下肢周围性瘫痪的病变部位是
A. 脊髓胸段
B. 脊髓颈膨大
C. 脊髓圆锥
D. 脊髓高颈段
E. 马尾

正确答案：E。马尾

解析：双下肢周围性瘫痪的病变部位是马尾（E对），马尾是腰骶尾部的神经根于终丝周围形成（P23）。脊髓高颈段（D错）损伤时表现为损伤平面以下感觉缺失，四肢呈上运动神经元性瘫痪（P22）；脊髓颈膨大（B错）损伤时表现为两上肢下运动神经元性瘫痪，两下肢上运动神经元性瘫痪（P22）；脊髓胸段（A错）损伤时表现为平面以下各种感觉缺失，双上肢正常，双下肢呈上运动神经元性瘫痪（P23）；脊髓末端变细呈圆锥状，称为脊髓圆锥（C错），主要包括骶3-5和尾节，损伤时无双下肢瘫痪，也无锥体束征，表现为肛门及会阴部感觉缺失，肛门反射消失和性功能障碍（P23）。